提取分离叶绿素用的溶剂是
A. 水
B. 甲醇
C. 乙醇
D. 乙酸乙酯
E. 甲醚

正确答案：C。乙醇

解析：本题考查的是叶绿素的提取分离。提取分离叶绿素用的溶剂是乙醇（C对）。分离叶绿素可用醇提水沉法。水提醇沉法和醇提水沉法：这两种方法是利用两种以上不同溶剂的极性和溶解性差异进行分离。在溶液中加入另一种溶剂以改变混合溶剂的极性，使一部分物质沉淀析出，从而实现分离。常见如在药材浓缩水提取液中加入数倍量高浓度乙醇，以沉淀除去多糖、蛋白质等水溶性杂质达到分离的目的称为水提醇沉法（也称水/醇法）。在浓缩乙醇提取液中加入数倍量水（A错）稀释，放置以沉淀除去树脂、叶绿素等水不溶性杂质达到分离目的的方法称为醇提水沉法（醇/水法）等。同理，在乙醇浓缩液中加入数倍量乙醚（醇/醚法）或丙酮（醇/丙酮法），可使皂苷沉淀析出，而脂溶性的树脂等类杂质则留存在母液中，也是分离常用的方法之一。